种植单位必须有专人负责，严加保管、严禁自行销售和使用的是
A. 赛加羚羊
B. 甘草
C. 龙胆
D. 洋金花
E. 罂粟

正确答案：D。洋金花